关于NK细胞正确的叙述是
A. 表达特异性抗原识别受体
B. 具有MHC的限制性
C. 具有ADCC效应
D. 分泌与TH2相同的细胞因子
E. 具有抗体产生作用

正确答案：C。具有ADCC效应

解析：NK细胞不表达特异性抗原识别受体，而是通过表面活化受体和抑制性受体对“自身”与“非己”进行识别，并直接杀伤某些肿瘤和病毒感染的靶细胞。NK细胞也可通过ADCC作用杀伤肿瘤和病毒感染的靶细胞。TH2细胞分泌IL-4、IL-5、IL-10、及IL-13等细胞因子，而NK细胞分泌IFN-γ与IFN-α。掌握“B淋巴细胞”知识点。